虎杖中主要蒽醌类化学成分
A. 大黄素
B. 大黄酚
C. 大黄素葡萄糖苷
D. 大黄酸
E. 氧化苦参碱

正确答案：A、B、C、D。大黄素；大黄酚；大黄素葡萄糖苷；大黄酸

解析：本题考查的是虎杖的主要化学成分。虎杖中主要蒽醌类化学成分大黄素（A对）、大黄酚（B对）、大黄素葡萄糖苷（C对）与大黄酸（D对）。虎杖主要含有蒽醌类化合物。蒽醌类成分包括大黄素、大黄酚、大黄酸、大黄素甲醚-1-β-D-葡萄糖苷、大黄素-1-β-D-葡萄糖苷、6-羟基芦荟大黄素、大黄素-8-单甲醚、6-羟基芦荟大黄素-8-单甲醚等。此外，还含有非蒽醌类的化合物如虎杖苷等。《中国药典》采用高效液相色谱法测定药材中大黄素和虎杖苷的含量，大黄素不得少于0.60%，虎杖苷不得少于0.15%。氧化苦参碱（E错）为苦参主要化学成分。苦参所含主要生物碱是苦参碱和氧化苦参碱，《中国药典》以其为指标成分进行鉴别和含量测定，含量测定要求苦参碱和氧化苦参碱总量不得少于1.2%。此外还含有羟基苦参碱、N-甲基金雀花碱、安那吉碱、巴普叶碱和去氢苦参碱（苦参烯碱）等。